胸神经前根含有
A. 躯体、内脏运动纤维
B. 躯体运动、副交感神经纤维
C. 感觉、运动纤维
D. 感觉、交感纤维
E. 躯体运动、内脏感觉纤维

正确答案：A。躯体、内脏运动纤维

解析：胸神经前根控制肋间肌、胸肌及腹肌的运动以及胸外侧壁和肩胛区的皮肤和胸前壁的皮肤及胸膜壁层的内侧份，所以胸神经前根含有躯体运动纤维和内脏运动纤维（A对）